在梦中将潜意识的欲望或意念用其他甚至相反的形式表现出来的是
A. 象征
B. 移置
C. 凝缩
D. 投射
E. 变形

正确答案：E。变形

解析：变形：指在梦中将潜意识的欲望或意念用其他甚至相反的形式表现出来。掌握“心理治疗原则、主要方法及应用”知识点。